具有蛋白质四级结构的蛋白质分子，在一级结构分析时发现
A. 具有一个以上N端和C端
B. 只有一个N端和C端
C. 具有一个N端和几个C端
D. 具有一个C端和几个N端
E. 一定有二硫键存在

正确答案：A。具有一个以上N端和C端